有关供水单位卫生许可证的发放，正确的是
A. 供水单位卫生许可证由县级以上人民政府卫生计生主管部门发放，有效期三年，有效期满前三个月重新提出申请换发新证
B. 供水单位卫生许可证由省级以上人民政府卫生计生主管部门发放，有效期三年，有效期满前三个月重新提出申请换发新证
C. 供水单位卫生许可证由县级以上人民政府卫生计生主管部门发放，有效期四年，有效期满前三个月重新提出申请换发新证
D. 供水单位卫生许可证由省级以上人民政府卫生计生主管部门发放，有效期四年，有效期满前三个月重新提出申请换发新证
E. 供水单位卫生许可证由县级以上人民政府卫生计生主管部门发放，有效期四年，有效期满前六个月重新提出申请换发新证

正确答案：E。供水单位卫生许可证由县级以上人民政府卫生计生主管部门发放，有效期四年，有效期满前六个月重新提出申请换发新证

解析：本题考查供水单位卫生许可证的发放。供水单位卫生许可证由县级以上人民政府卫生计生部门发放，有效期四年。有效期满前六个月重新提出申请换发新证（E对ABCD错）。